成年恒牙急性根尖周炎须在急性症状缓解后再行
A. 安抚
B. 直接充填
C. 间接充填
D. 根管治疗
E. 根尖诱导成形术

正确答案：D。根管治疗

解析：急性根尖周炎须在急性症状缓解后再行根管治疗。掌握“根管治疗术概述”知识点。